大补元煎的组成是
A. 人参、熟地黄、山药、山萸肉、菟丝子、炙甘草、远志、五味子
B. 人参、熟地黄、山药、山萸肉、枸杞子、炙甘草、杜仲、当归
C. 人参、熟地黄、黄芪、白术、茯神、远志、 酸枣仁、当归
D. 人参、熟地黄、黄芪、白术、茯苓、甘草、 白芍、当归
E. 人参、熟地黄、黄苗、白术、陈皮、柴胡、 升麻、当归

正确答案：B。人参、熟地黄、山药、山萸肉、枸杞子、炙甘草、杜仲、当归

解析：大补元煎《景岳全书》的功效为大补元气，益精养血，由人参 山药 熟地黄 杜仲 当归 山茱萸 枸杞 炙甘草组成，方歌：大补元煎元气伤，芋肉杜仲入肾阳，熟地参草淮山药，当归枸杞生化藏（B对）。